属于抗胆碱药的是
A. 异丙阿托品
B. 麻黄碱
C. 沙丁胺醇
D. 异丙肾上腺素
E. 克仑特罗

正确答案：A。异丙阿托品

解析：本题考查抗胆碱药。属于抗胆碱药的是异丙阿托品（A对）。异丙阿托品别名异丙托溴铵，具有强效抗胆碱（M受体）作用，对支气管平滑肌有较高的选择性。麻黄碱（B错）为α、β肾上腺素受体激动剂。沙丁胺醇（C错）、克仑特罗（E错）为选择性β₂受体激动剂。异丙肾上腺素（D错）为β受体激动剂。